药物信息取之不尽用之不竭的源泉是
A. 国家药典
B. 政府文件
C. 专业书籍
D. 专业期刊
E. 药物手册

正确答案：D。专业期刊

解析：本题考查药物信息的分类。药物信息取之不尽用之不竭的源泉是药学信息中的一次文献即原始资料，包括国内期刊、国外期刊、药学科技资料等药学资料（D对）。国家药典（A错）为二级信息源，用来检索一级文献。政府文件（B错）、专业书籍（C错）、药物手册（E错）为三级信息源。